女性，70岁，无牙颌。戴用全口义齿1周，自诉义齿固位差，易脱落。复诊时首先应做的是
A. 询问患者义齿何时易松动
B. 先让患者咀嚼试用
C. 检查固位力大小
D. 检查大张口时是否脱落
E. 检查基托边缘伸展

正确答案：A。询问患者义齿何时易松动

解析：全口义齿松动的原因包括初戴不适应（偶尔松动）；固位力过小，张口即脱落；边缘过长等妨碍周围组织活动或边缘封闭差，大张口、说话、打哈欠时脱落；咬合不平衡导致咀嚼时松动等。应首先询问患者义齿松动、脱落的时间和方式。掌握“全口义齿戴入后问题及处理”知识点。